颞下颌关节脱位以下列哪种脱位方式最常见
A. 后方脱位
B. 前方脱位
C. 上方脱位
D. 内侧脱位
E. 外侧脱位

正确答案：B。前方脱位

解析：本题考查颞下颌关节脱位最常见的脱位方式。颞下颌关节脱位是指髁突脱出关节窝以外，超越了关节运动的正常限度，以致不能自行复回原位者。按髁突脱出的方向、位置可分为前方脱位、后方脱位、上方脱位及侧方脱位。临床上以前方脱位（B对）较常见，原因是翼外肌收缩把髁突过度地向前拉过关节结节，使髁突脱位于关节结节前上方，或是因患者本身关节结节过高或关节结节过陡所致。后方脱位（A错）、上方脱位（C错）和内、外侧方脱位（DE错）比较少见，主要在受外力损伤时发生。